下列不属于血管紧张素转换酶抑制剂（ACEI）特点的是
A. 引起反射性心率加快
B. 可用于各型高血压
C. 对肾脏有保护作用
D. 可防治高血压患者心肌细胞肥大
E. 减少循环组织的血管紧张素Ⅱ

正确答案：A。引起反射性心率加快

解析：本题考查血管紧张素转换酶抑制剂（ACEI）的特点。引起反射性心率加快（A错，为本题的正确答案）可见于硝苯地平（钙通道阻滞剂）。血管紧张素转换酶抑制剂（ACEI）的特点有：减少循环组织的血管紧张素Ⅱ（E对）；可用于各型高血压（B对），治疗高血压疗效好，轻中度高血压患者单用ACEI常可控制血压：加用利尿药增效，比加大ACEI的剂量更有效；肾血管性高血压因其肾素水平高，ACEI特别有效，对心、肾、脑等器官有保护作用，且能减轻心肌肥厚（D对），阻止或逆转心血管病理性重构。对伴有心衰或糖尿病、肾病的高血压患者，ACE抑制药为首选药。因肾小球囊内压升高可致肾小球与肾功能损伤，糖尿病患者常并发肾脏病变，ACEI对1型和2型糖尿病，无论有无高血压均能改善或阻止肾功能的恶化（C对）。